测定化学物LD₅₀时，常用的观察期限是
A. 7天
B. 10天
C. 14天
D. 28天

正确答案：C。14天

解析：本题考查测定化学物LD₅₀时，常用的观察期限。LD₅₀即半数致死剂量，指引起一组受试实验动物半数死亡的剂量。测定化学物LD₅₀时，常用的观察期限是14天（C对ABD错）。